青春期自我意识中的主要矛盾不包括
A. 理想与现实
B. 性意识与社会规范
C. 本我与超我
D. 独立与依赖
E. 交往与封闭

正确答案：C。本我与超我